乳牙拔除后是否制作功能保持器应考虑
A. 恒牙是否先天缺失
B. 恒牙胚上方骨板厚度
C. 邻牙萌出的顺序
D. 牙齿拥挤程度
E. 以上各项都对

正确答案：E。以上各项都对

解析：乳牙拔除后，为了防止邻牙向丧失部位倾斜和对颌牙伸长，应设计间隙保持器来保持早失牙齿的近远中和垂直的间隙，保证继承恒牙的正常萌出，这种方法也叫间隙管理或被动咬合诱导。保持器应考虑的因素有：1.儿童的年龄和牙龄。乳牙早失后，牙齿间隙缩窄最快发生在拔牙后的6个月内，如继承恒牙于近期内不能萌出，间隙就会减小，需及时做间隙保持器；2.恒牙胚发育情况。通过X线片了解继承恒牙牙胚发育情况，有无扭转、弯曲和错位，能否正常萌出；要注意观察恒牙胚上方骨板厚度（B对）及其是否完整，来预测继承恒牙萌出时间；还要观察恒牙是否先天缺失（A对），若有缺失则应与正畸、修复医师会诊，综合观察全口牙咬合情况，决定保持间隙以后义齿修复或使邻牙前移以关闭间隙；3.邻牙萌出的顺序（C对）。除第二前磨牙先天缺失而有意关闭间隙的病例外，第二乳磨牙早失均应及时做间隙保持器；4.骨量与牙量的关系。根据牙齿拥挤程度（D对）合理选择是否进行间隙保持，若患儿骨量明显大于牙量，患儿牙列中有散在的间隙，无拥挤的趋势，可进行临床观察，选择时机决定是否做间隙保持器。5.年轻恒牙早失的间隙处理。恒前牙早失后，短期内牙齿就可能移位。因此，需尽可能早作间隙保持器。如已有间隙缩小或关闭，则应扩展间隙后再制作间隙保持器。（ABCD均对，故E为本题的正确答案）。